具有活血止痛，行气解郁，凉血清心功效的药物是
A. 川芎
B. 丹参
C. 延胡索
D. 姜黄
E. 郁金

正确答案：E。郁金

解析：该题考查郁金的功效。郁金味辛、苦，性寒，归肝、胆、心经，其功效为活血止痛，行气解郁，清心凉血，利胆退黄（E对）。